治疗慢性心功能不全和逆转心肌肥厚并能降低病死率的药物是
A. 强心甙
B. 哌唑嗪
C. 硝酸甘油
D. 酚妥拉明
E. 卡托普利

正确答案：E。卡托普利

解析：卡托普利是血管紧张素转换酶抑制剂，其可降低外周阻力，降低心脏后负荷，减少醛固酮的生成，降低降低交感神经活性，用于治疗慢性心功能不全，并且可以防止和逆转心肌和血管重构，改善心功能，所以可以逆转心肌肥厚并能降低病死率（E对）。强心甙（A错）（P237）为正性肌力药物，可以用于治疗慢性心力衰竭，但并没有逆转心肌肥厚并能降低病死率的作用。哌唑嗪（B错）（P227）为α₁受体阻断药，主要用来治疗高血压。硝酸甘油（C错）（P255）是常用的抗心绞痛药物，基本药理作用是松弛平滑肌，但具有组织器官的选择性，以对血管平滑肌的作用最显著。酚妥拉明（D错）主要用于周围血管疾病的治疗。